胸主动脉的分支不包括
A. 肋下动脉
B. 肋间后动脉
C. 支气管动脉
D. 膈上动脉
E. 胸廓内动脉

正确答案：E。胸廓内动脉

解析：肋下动脉（A对）、肋间后动脉（B对）、支气管动脉（C对）、膈上动脉（D对）均为胸主动脉的分支。胸廓内动脉（E错，为本题正确答案）为锁骨下动脉的主要分支。